下列关于掌跖角化-牙周破坏综合征临床表现的叙述中，不恰当的一项是
A. 恒牙萌出后按序发生牙周破坏
B. 患儿智力及身体发育异常
C. 乳牙萌出后不久即可发生深牙周袋
D. 皮损及牙周病变常在4岁前共同出现
E. 特点是手掌和脚掌部位的皮肤过度角化、皲裂和脱屑

正确答案：B。患儿智力及身体发育异常

解析：掌跖角化-牙周破坏综合征，其特点是手掌和脚掌部位的皮肤过度角化、皲裂和脱屑，牙周组织严重破坏，本病较罕见。临床表现：皮损及牙周病变常在4岁前共同出现，有人报道可早在出生后11个月发生。皮损包括手掌、足底、膝部及肘部局限性的过度角化及鳞屑、皲裂，有多汗和臭汗。约有1/4患者易有身体其他处感染。患儿智力及身体发育正常（B错，为本题正确答案）。牙周病损在乳牙萌出不久即可发生，有深牙周袋，炎症严重，溢脓、口臭，牙槽骨迅速吸收，约在5～6岁时乳牙即相继脱落，创口愈合正常。待恒牙萌出后又按萌出的顺序相继发生牙周破坏，常在10多岁时即自行脱落或拔除。有的患者第三磨牙也会在萌出后数年内脱落，有人则报道第三磨牙不受侵犯。掌握“反应全身疾病的牙周炎”知识点。